某女，72岁，患有高血压、冠心病。近日喘咳气涌，痰黏色黄，伴胸中烦闷，身热，有汗。舌红苔黄腻，脉滑数。中医辨证为痰热郁肺。治法为清热化痰、宣肺止咳。不宜选用的中成药是
A. 橘红丸
B. 止嗽定喘口服液
C. 清肺抑火丸
D. 蛇胆川贝液
E. 清气化痰丸

正确答案：B。止嗽定喘口服液

解析：本题考查的是止咳平喘剂的使用注意事项。患有高血压、冠心病。近日喘咳气涌，痰黏色黄，伴胸中烦闷，身热，有汗。舌红苔黄腻，脉滑数。中医辨证为痰热郁肺。治法为清热化痰、宣肺止咳。不宜选用的中成药是止嗽定喘口服液（B错，为本题正确答案）。止嗽定喘口服液：【注意事项】孕妇、阴虚久咳者慎用。服药期间，忌食辛辣、油腻食物。因其含麻黄，故青光眼患者、高血压病患者、心脏病患者慎用。橘红丸（A对）：【注意事项】孕妇、气虚咳喘及阴虚燥咳者慎用。服药期间，忌食辛辣、油腻食物。清肺抑火丸（C对）：【注意事项】孕妇、风寒咳嗽、脾胃虚弱者慎用。服药期间，忌食生冷、辛辣、燥热食物，忌烟酒。蛇胆川贝液（D对）：【注意事项】孕妇慎用。痰湿犯肺或久咳不止者慎用。服药期间，忌食辛辣、油腻食物，忌吸烟、饮酒。清气化痰丸（E对）：【注意事项】孕妇、风寒咳嗽、痰湿阻肺者慎用。服药期间，忌食生冷、辛辣、燥热食物，忌烟酒。